关于伪造、变造、买卖、出租、出借药品经营许可证法律责任叙述错误的是
A. 有违反所得的，没收违法所得并处一倍以上五倍以下罚款
B. 违法所得不足十万元的，按十万元计算
C. 情节严重的，撤销药品批准证明文件
D. 情节严重的，对法定代表人处十万元以下的罚款

正确答案：D。情节严重的，对法定代表人处十万元以下的罚款

解析：本题考查伪造、变造、买卖、出租、出借许可证或者药品批准证明文件的法律责任。伪造、变造、出租、出借、非法买卖许可证或者药品批准证明文件，情节严重的对法定代表人、主要负责人、直接负责的主管人员和其他责任人员，处二万元以上二十万元以下的罚款（D错，为本题正确答案）。伪造、变造、买卖、出租、出借许可证或者药品批准证明文件的法律责任：行政许可是行政机关根据公民、法人或者其他组织的申请，经依法审查，准予其从事特定活动的行为（参见《中华人民共和国行政许可法》第2条）。行政许可具有法律效力，它解除了行政相对人从事特定活动的禁止，赋予了行政相对人相应的权利。《中华人民共和国行政许可法》第9条规定，依法取得的行政许可，除法律、法规规定依照法定条件和程序可以转让的外，不得转让。根据《药品管理法》第一百二十二条规定，伪造、变造、出租、出借、非法买卖许可证或者药品批准证明文件的，没收违法所得，并处违法所得一倍以上五倍以下的罚款（A对）；情节严重的，并处违法所得五倍以上十五倍以下的罚款，吊销药品生产许可证、药品经营许可证、医疗机构制剂许可证或者药品批准证明文件（C对），对法定代表人、主要负责人、直接负责的主管人员和其他责任人员，处二万元以上二十万元以下的罚款，十年内禁止从事药品生产经营活动，并可以由公安机关处五日以上十五日以下的拘留；违法所得不足十万元的，按十万元计算（B对）。